男性，岁，阵发性上腹痛伴嗳气、反酸，进食后疼痛缓解，就诊后诊断为十二指肠溃疡。该溃疡最可能发生于十二指肠的何部
A. 十二指肠下部
B. 十二指肠降部
C. 十二指肠球
D. 十二指肠空肠曲
E. 十二指肠升部

正确答案：C。十二指肠球

解析：十二指肠球(C对)为十二指肠溃疡的好发部位。